续断的功效为
A. 祛风湿，补肝肾，强筋骨，安胎
B. 祛风湿，强筋骨，利水消肿
C. 补肝肾，强筋骨，安胎
D. 补肝肾，行血脉，续筋骨，安胎止漏
E. 补肝肾，强筋骨，祛风湿

正确答案：D。补肝肾，行血脉，续筋骨，安胎止漏

解析：续断甘温能补，苦辛行散，补中有行，补而不滞。入肝、肾经，既补肝肾，又行血脉，还续筋骨，为内科补肝肾、妇科止崩漏、伤科疗折伤之要药（D对）。祛风湿，补肝肾，强筋骨，安胎（A错）的中药是桑寄生。功效为祛风湿，强筋骨，利水消肿（B错）的中药为五加皮。功效为补肝肾，强筋骨，安胎（C错）的中药是杜仲。功效为补肝肾，强筋骨，祛风湿（E错）的中药为狗脊。